何某为去乡下度假，要求在医院工作的朋友为其开一周病假，顺便为祖母开些降压药及常备药，这种情况属于
A. 供非所求
B. 求非所需
C. 供求平衡
D. 潜在需要
E. 诱导需求

正确答案：B。求非所需